关于糖皮质激素的作用，下列哪项错误
A. 促进全身各部位的脂肪分解
B. 促进肝外组织蛋白分解
C. 促进糖异生
D. 促进肾保钠、保水
E. 减少外周组织对葡萄糖的利用

正确答案：A。促进全身各部位的脂肪分解